患儿，10岁。反复水肿，少尿1年。体检：四肢明显水肿，呈凹陷性，血压：17/12kPA(130/90mmHg)，心肺正常，腹软，尿检：蛋白（+++），红细胞15~20个/HP，血白蛋白23g/L，胆固醇9.2mmol/L。该患儿做肾病理活检可呈以下改变，但主要的病理变化是
A. 微小病变型
B. 系膜增生性
C. 局灶、节段性肾小球硬化
D. 膜性肾病
E. 膜增生性肾炎

正确答案：A。微小病变型

解析：儿童，反复水肿，少尿1年，体检：四肢明显水肿，呈凹陷性（肾病综合征的典型临床表现），血压：130/90mmHg（正常值为90～140/60～90mm/Hg），心肺正常，腹软，尿检：蛋白（+++），红细胞15~20个/HP，血白蛋白23g/L（正常值>25g/L，白蛋白降低），胆固醇9.2mmol/L（正常值<5.7mmol/L，胆固醇升高），该患儿大量蛋白尿、低蛋白血症、高血脂症、水肿，考虑最可能的诊断为肾病综合征，儿童肾病综合征最主要的病理变化是微小病变型（A对）。局灶性节段性肾小球硬化（C错）占6.9 %、膜性增生性（E错）肾小球肾炎占7.5%、单纯系膜增生（B错）占2.3%、膜性肾病（D错）1. 5%。